某女，38岁，身高162cm，体重77kg。根据BMI判断该女性的营养状况为
A. 肥胖
B. 超重
C. 正常
D. 消瘦
E. 极消瘦

正确答案：A。肥胖

解析：本题考查该女性的营养状况。本题中该女性38岁，身高162cm，体重77kg。BMI＝体重（kg）/[身高（m）]²＝77/1.62²＝29.3kg/m²，根据我国成人BMI标准，BMI≥28.0为肥胖，可知该女性的营养状况为肥胖（A对BCDE错）。